反映工人接触水平的最佳方式是
A. 主动采集
B. 被动采集
C. 集气法
D. 个体采样
E. 定点区域采样

正确答案：D。个体采样